患儿2岁，入院体检发现HBsAg阳性，抗—HBe阳性，肝功能正常。母亲HBsAg阳性。最可能的诊断是
A. 慢性乙肝病毒携带者
B. 慢性乙型肝炎轻度
C. 慢性乙型肝炎中度
D. 急性乙型肝炎
E. 乙肝病毒既往感染者

正确答案：A。慢性乙肝病毒携带者

解析：本例患者为患儿，体检发现HBsAg阳性，抗-HBe阳性，肝功能正常，其母HBsAg阳性，考虑为乙型肝炎母婴垂直传播，患儿尚未出现肝损伤，考虑为慢性乙型肝炎病毒携带者（A对BCDE错）。